下颌姿势位的意义是
A. 正常人在24小时内上下颌牙接触的时间仅十几分钟
B. 升降下颌骨肌不收缩，可使咀嚼肌得到充分休息
C. 形成一定的间隙，可使舌位于此间隙内
D. 便于下颌处于正中关系
E. 便于下颌由正中关系自如地运动到非正中关系

正确答案：A。正常人在24小时内上下颌牙接触的时间仅十几分钟

解析：下颌姿势位的意义：下颌姿势位时上、下颌牙不接触，不产生非咀嚼性磨损，牙周与颞下颌关节组织不受力，口颌肌比较放松，这是维持口颌系统健康所必需的。正常人在24小时内上下颌牙接触的时间仅十几分钟。掌握“下颌姿势位、三类颌位与前伸、侧方（牙合）颌位”知识点。